男，25岁。发热3周于8月20日来诊，体温大于39℃，病初皮肤出现少数皮疹，头痛，腰痛，眼眶痛。患者可能病症是
A. 肾综合征出血热
B. 流行性乙型脑炎热
C. 麻疹
D. 风疹
E. 肾病综合征

正确答案：A。肾综合征出血热

解析：25岁男性患者，发热3周（肾综合征出血热发热期症状），于8月20日来诊（肾综合征出血热高发季节），体温大于39℃，病初皮肤出现少数皮疹（毛细血管损害征），头痛，腰痛，眼眶痛（肾综合征出血热典型“三痛”症状），患者可能病症是肾综合征出血热（A对），又称流行性出血热，是以鼠类为主要传染源的一种自然疫源性疾病。本病的主要变化是全身小血管和毛细血管广泛性损害，临床上以发热、低血压休克、充血出血和肾损害为主要表现。流行性乙型脑炎（B错）临床上以高热、意识障碍、抽搐、病理反射及脑膜刺激征为特征，无皮疹（P86）。麻疹（C错）（P63）、风疹（D错）（P67）不出现腰痛、眼眶痛。肾病综合征（E错）（NS）可由多种病因引起，以肾小球基膜通透性增加，表现为大量蛋白尿、低蛋白血症、高度水肿、高脂血症的一组临床症候群，无皮疹（八版内科学P477）。